女性，40岁，主诉牙龈增生2年，有高血压病史。检查：全口牙龈增生，覆盖牙冠的1/3～1/2，牙龈乳头因增生而相连，牙龈表面有的呈桑葚状，牙龈质地坚韧，呈暗红色，造成以上症状的原因是患者可能服用了
A. 苯巴比妥钠
B. 环孢素
C. 硝酸异山梨酯
D. 硝苯地平
E. 降压灵

正确答案：D。硝苯地平

解析：本题考查药物性牙龈肥大有关的药物。患者牙龈增生2年，有高血压病史。全口牙龈增生，覆盖牙冠的1/3～1/2，牙龈乳头相连，牙龈呈桑葚状，质地坚韧，呈暗红色，综合考虑，患者为药物性牙龈肥大。由于患者有高血压病史，因此可能服用了硝苯地平（D对）。与药物性龈肥大有关的三类常用药物是：①抗癫痫药物，如苯妥英钠；②免疫抑制剂，如环孢素；③钙通道阻滞剂，如硝苯地平、维拉帕米等。苯妥英钠（A错）一般用于治疗癫痫；环孢素（B错）一般用于治疗器官移植后的免疫排斥反应。硝酸异山梨酯（C错）和降压灵（E错）一般不会引起药物性牙龈肥大。